ICD-10里抑郁症的标准日期至少是多久
A. 1天
B. 7天
C. 2周
D. 21天
E. 3天

正确答案：C。2周

解析：ICD-10里抑郁症的标准日期至少是2周（C对）。